增加修复体抗力的措施哪项是错误的
A. 减少修复体的体积和厚度，以便保留更多的牙体组织
B. 合理控制修复体的外形，避免尖、薄、锐的结构形式
C. 根据患牙条件和设计要求，选择理化性能优良的修复材料
D. 保证修复体制作质量
E. 控制（牙合）面形态及力方向

正确答案：A。减少修复体的体积和厚度，以便保留更多的牙体组织

解析：本题考查增加修复体抗力的措施。修复体应合乎抗力形的要求，使修复体和患牙都能抵抗（牙合）力而不致被破坏或折裂，修复体应有足够的的体积和厚度，以承担咬合压力（A错，为本题的正确答案）。要增加修复体抗力应合理控制修复体的外形，避免尖、薄、锐的结构形式（B对），否则这些区域在咬合力较大时容易折裂。应根据患牙条件和设计要求，选择理化性能优良的修复材料（C对），根据不同材料的不同性能，在不同的部位选择具体的、符合相应要求的修复材料。除此之外，还应保证修复体制作质量（D对）以保证修复体和患牙能抵抗（牙合）力而不致破坏和折裂。应控制（牙合）面形态及力方向（E对），避免形成应力集中的区域。